风痰的特征是
A. 色黄粘稠
B. 白而清稀
C. 清稀多泡沫
D. 白滑而量多
E. 少而粘稠

正确答案：C。清稀多泡沫

解析：风痰的特征为痰清稀而多泡沫（C对）。因热邪煎熬津液，故热痰的特征为痰黄粘稠，坚而成块（A错）。因寒伤阳气，气不化津，湿聚为痰，故寒痰的特征为痰白清稀，或多有灰黑点（B错）。因脾虚不运，水湿不化，聚而成痰，故湿痰的特征为白滑而量多，易咯出（D错）。因燥邪伤肺，耗伤肺津，或肺阴虚津亏，清肃失职，故燥痰的特征为痰少而粘稠，难于咯出（E错）。